八会穴中的脉会穴是
A. 阳陵泉
B. 悬钟
C. 太渊
D. 膻中
E. 中脘

正确答案：C。太渊

解析：该题考查八会穴，属基础记忆内容。太渊为手太阴肺经的穴位，同时也是八会穴中的脉会穴（C对）。阳陵泉是筋会穴（A错）。悬钟为髓会穴（B错）。膻中为气会穴（D错）。中脘穴为腑会穴（E错）。记忆：脏会章门，腑中脘，气会膻中，血膈俞，筋阳陵泉，脉会太渊，骨大杼，髓绝骨。